可改善心肌缺血症状，但高磷血症患者禁用的药物是
A. 二磷酸果糖注射液
B. 葡萄糖注射液
C. 乳酸钠注射液
D. 门冬氨酸钾镁注射液
E. 氯化钠注射液

正确答案：A。二磷酸果糖注射液

解析：本题考查二磷酸果糖。可改善心肌缺血症状，但高磷血症患者禁用的药物是二磷酸果糖注射液（A对）。二磷酸果糖可用于心肌缺血引起的各种症状，但能升高血液磷酸水平，禁用于高磷血症者。葡萄糖（B错）用于补充能量和体液。乳酸钠（C错）用于代谢性酸中毒。门冬氨酸钾镁（D错）用于低钾血症、低钾及洋地黄中毒引起的心律失常，心肌代谢障碍所致的心绞痛、心肌梗死、心肌炎后遗症，慢性心功能不全，急性黄疸性肝炎、肝细胞功能不全和急、慢性肝炎的辅助治疗。氯化钠（E错）用于调节渗透压。